长期应用氢化可的松突然停药可发生
A. 快速耐受性
B. 成瘾性
C. 耐药性
D. 反跳现象
E. 高敏性

正确答案：D。反跳现象

解析：氢化可的松是短效糖皮质激素，其突然停药或减量过快可出现反跳现象（D对）而致原病复发或恶化，其原因是患者对糖皮质激素产生了依赖性或因减量导致用量不足于控制病情所致，出现反跳现象常需加大剂量再行治疗，待症状缓解后再逐渐减量、停药。